子宫内膜异位症临床分期的依据是
A. 彩色超声多普勒检查
B. 典型病史及妇科检查
C. 宫腔镜检查
D. 腹腔镜检查
E. 血清CA125测定

正确答案：D。腹腔镜检查

解析：子宫内膜异位症临床分期的依据是：通过腹腔镜检查（D对）或剖腹探查手术，详细观察并对异位内膜的部位、数目、大小、粘连程度并对其进行记录，最后进行评分。典型病史及妇科检查（B错）、彩色超声多普勒检查（A错）、血清CA125测定（E错）为诊断子宫内膜异位症的辅助检查手段。宫腔镜检查（C错）不用于子宫内膜异位症的诊断和分期。